下列有关创伤性溃疡特点描述错误的是
A. 黏膜水肿明显
B. 常伴深大的溃疡
C. 治疗首先应进行活检
D. 局限于口腔软组织
E. 溃疡周围有炎症增生反应

正确答案：C。治疗首先应进行活检

解析：创伤性溃疡是由于长期慢性机械刺激或压迫而产生的口腔软组织损害。特点是慢性、深大的溃疡，周围有炎症增生反应，黏膜水肿明显。治疗首先应去除局部刺激因素，若能在病损周围发现对应的刺激物，一般去除刺激物后能迅速好转。若去除后仍不愈合，应及时活检明确诊断。掌握“创伤性溃疡”知识点。